汞抑制的酶主要是
A. 线粒体中的腺苷三磷酸酶
B. 某些含铁的酶
C. 某些含铜的酶
D. 含硫的酶
E. 细胞色素氧化酶

正确答案：D。含硫的酶